判断嵌顿性疝发展为绞窄性疝最重要的依据是
A. 嵌顿的时间长
B. 肠壁张力下降
C. 出现肠梗阻表现
D. 疝内容物缺血坏死
E. 肠蠕动减弱

正确答案：D。疝内容物缺血坏死

解析：嵌顿性疝如能及时解除，病变肠管可恢复正常。嵌顿如不及时解除，肠壁及其系膜受压情况不断加重可使动脉血流减少，疝内容物就会缺血坏死（D对）。这是判断嵌顿性疝发展为绞窄性疝最重要的依据。